胃癌术前能明确肿瘤浸润深度的检查是
A. 腹部CT
B. X线钡剂造影
C. 染色内镜
D. 内镜超声
E. 腹部MRI

正确答案：D。内镜超声

解析：胃镜检查结合黏膜活检是目前胃癌最可靠的诊断手段，胃癌病灶处的内镜超声检查（D对）可较准确地明确肿瘤侵犯深度，同时腹部CT（A错）能提高胃癌临床分期的精确度；X线钡剂（B错）检查可能发现胃内的溃疡及隆起型病灶，分别呈龛影或充盈缺损；染色内镜（C错）和腹部MRI（E错）一般不用于胃癌的检查。